治疗急性心肌梗死阳气虚衰，寒凝心络证，应首选
A. 四逆汤合桃红四物汤
B. 生脉散合血府逐瘀汤
C. 六味地黄汤合补中益气汤
D. 瓜蒌薤白白酒汤合苓桂术甘汤
E. 参附汤合枳实薤白桂枝汤

正确答案：E。参附汤合枳实薤白桂枝汤

解析：急性心肌梗死阳气虚衰，寒凝心络证，治宜益气温阳、开痹散寒，首选益气回阳固脱的参附汤合通阳散结，祛痰下气的枳实薤白桂枝汤加减（E对）。四逆汤功用回阳救逆，合养血活血的桃红四物汤，适用于血虚寒厥证（A错）。生脉散功用益气生津，敛阴止汗，合活血化瘀，行气止痛的血府逐瘀汤，适用于气阴亏损，心络瘀阻证（B错）。六味地黄汤功用填精滋阴补肾，合补中益气，生阳健脾的补中益气汤，适用于脾气不足，肾阴亏虚之证（C错）。瓜蒌薤白白酒汤功用通阳散结，行气祛痰，合温阳化饮，健脾利水的苓桂术甘汤，适用于脾阳不足，痰湿内阻证（D错）。